胰的毗邻
A. 胰完全位于腹上区
B. 平对第3腰椎体
C. 前方邻胆总管、肝门静脉等结构
D. 后方有网膜囊
E. 左端抵达脾门

正确答案：E。左端抵达脾门

解析：肝位于腹上区和左季肋区(A错)，在第1～2腰椎体前方(B错)，前方有网膜囊(D错)，后方邻胆总管、肝门静脉等结构(C错)，左端抵达脾门(E对)。